概率抽样不包括
A. 分层整群抽样
B. 单纯随机抽样
C. 偶遇抽样
D. 系统抽样

正确答案：C。偶遇抽样

解析：本题考查概率抽样。常用的概率抽样方法有单纯随机抽样（B对）、分层抽样、系统抽样（D对）、整群抽样（A对）等。偶遇抽样（C错，为本题正确答案）属于非概率抽样。